患者黄疸日久，黄色晦暗如烟熏，纳少脘闷，大便溏，神疲畏寒，口淡不渴，舌淡苔腻，脉沉迟。治疗应首选
A. 茵陈蒿汤
B. 茵陈五苓散
C. 甘露消毒丹
D. 黄连温胆汤
E. 茵陈术附汤

正确答案：E。茵陈术附汤

解析：题中患者黄疸日久，黄色晦暗如烟熏，故诊断为阴黄。寒湿阻滞脾胃，阳气不宣，胆汁外泄，因寒湿为阴邪，故黄色晦暗如烟熏；纳少脘闷，大便溏，口淡不渴等症，都是湿困中土，脾阳不振，运化功能失常的表现；阳气已虚，气血不足，则神疲畏寒；舌淡苔腻，脉沉迟系阳虚湿浊不化，寒湿留于阴分之象,故诊断为寒湿阻遏证，治疗应该用茵陈术附汤温中化湿，健脾和胃（E对）。茵陈蒿汤清热通腑，利湿退黄，为热重于湿证之阳黄的代表方（A错）。茵陈五苓散利湿退黄（B错），甘露消毒丹利湿化浊，清热解毒（C错），两方合用治疗湿重于热证之阳黄。黄连温胆汤清热化痰，宁心安神，为痰火扰心证之心悸的代表方（D错）。